HP非侵入式检查方法
A. 快速尿素酶
B. PCR
C. HP培养
D. ¹³C
E. 病理切片

正确答案：D。¹³C

解析：Hp非侵入式检查方法主要为13C-或14C-尿素呼气试验（D对）。快速尿素酶（A错）、Hp培养（C错）、病理切片（E错）均为侵入式检查方法。PCR方法并未在九版内科学幽门螺杆菌检查中提及（B错）。